患者，男，42岁，诊断为2型糖尿病，严重便秘病史，腹胀明显。不宜选用的降糖药物是
A. 瑞格列奈
B. 阿卡波糖
C. 二甲双胍
D. 沙格列汀
E. 胰岛素

正确答案：B。阿卡波糖

解析：本题考查阿卡波糖。既往严重便秘，腹胀明显，不宜选用的降糖药物是阿卡波糖（B错，为本题正确答案）。阿卡波糖会引起肠道细菌酵解，产生气体，引起胀气、腹泻等胃肠道不良反应。瑞格列奈（A对）为非磺酰脲类促胰岛素分泌药，吸收快、起效快，作用时间短，既可降低空腹血糖，又可降低餐后血糖，无需餐前0.5h服用，因而又称为“餐时血糖调节剂”。二甲双胍（C对）首选用于单纯饮食控制及体育锻炼治疗无效的2型糖尿病，特别是肥胖的2型糖尿病。沙格列汀（D对）可作为单药治疗，在饮食和运动基础上改善血糖控制。当单独使用盐酸二甲双胍血糖控制不佳时，可与盐酸二甲双胍联合使用，在饮食和运动基础上改善血糖控制。胰岛素（E对）主要用于糖尿病，特别是1型糖尿病的治疗，可用于纠正细胞内缺钾。